患者女性，29岁，结婚两年未育，现停经8周感下腹隐痛伴阴道少许流血3天。妇科检查阴道少许血液，宫颈口未扩张，子宫约50天孕大，软，双附件正常最佳治疗方案是
A. 药物人工周期治疗
B. 抗感染治疗
C. 腹探查术
D. 诊断性刮宫
E. 保胎治疗

正确答案：E。保胎治疗

解析：先兆流产指妊娠28周前，先出现少量阴道流血，常为暗红色或血性白带，无妊娠物排出，相继出现阵发性下腹痛或腰背痛。妇科检查宫颈口未开，胎膜未破，子宫大小与停经周数相符。经休息及治疗，症状消失，可继续妊娠；若阴道流血量增多或下腹痛加剧，可发展为难免流产。处理：应卧床休息，禁忌性生活。黄体酮每日肌注20mg，对黄体功能不足的患者，具有保胎效果。维生素E、小剂量甲状腺片也可应用。经治疗两周，症状不见缓解或反而加重者，应停止治疗，让其流产。或进行B型超声检查及β-HCG测定，了解胚胎的状态，给以相应处理，包括终止妊娠。掌握“自然流产”知识点。